不是细菌合成代谢产物的是
A. 内毒素
B. 外毒素
C. 类毒素
D. 色素
E. 侵袭性酶类

正确答案：C。类毒素

解析：本题考查细菌的生理。类毒素（C错，为本题正确答案）toxoid；anatoxin又称减力毒素，变性毒素。一些经变性或经化学修饰而失去原有毒性而仍保留其免疫原性的毒素。如某些细菌外毒素可用甲醛等处理后脱毒的制品，毒性虽消失，但免疫原性不变，故仍然具有刺激人体产生抗毒素，以起到机体从此对某疾病具有自动免疫的作用。它们广泛地应用于预防某些传染病。如向人体注射白喉类毒素后可以预防白喉。其他的还有破伤风类毒素、葡萄球菌类毒素、霍乱类毒素等。亦可把它们注射到动物体内用于制备抗毒素。